男性，14岁。患Ⅰ型糖尿病2年，近日在家中使用胰岛素治疗，突然发生昏迷。其昏迷原因最可能是
A. 糖尿病高渗性昏迷
B. 乳酸性酸中毒
C. 呼吸性酸中毒
D. 尿毒症酸中毒
E. 低血糖昏迷

正确答案：E。低血糖昏迷

解析：患者青少年男性，患有Ⅰ型糖尿病，使用胰岛素（其主要不良反应是低血糖）治疗后突发昏迷，其昏迷原因最可能是低血糖昏迷（E对）。使用胰岛素后血糖明显下降，不会出现糖尿病高渗性昏迷（P755）（A错）。乳酸性酸中毒（P746）（B错）以药源性低血糖为主要特征，多因服用大量降糖药物引起（如双胍类药物），临床发生率较低。呼吸性酸中毒（C错）常由呼吸中枢受损、呼吸道阻塞和肺部疾病导致；尿毒症酸中毒（P526）（D错）主要发生于慢性肾衰竭患者；后两者与胰岛素治疗关系不大。